组织供氧量取决于
A. Pa02和氧容量
B. Pa02和肺换气功能
C. 血红蛋白的质和量
D. 静脉血氧饱和度和血流量
E. 动脉血氧含量和血流量

正确答案：E。动脉血氧含量和血流量

解析：组织供氧量取决于动脉血氧含量和血流量（E对）。Pa02和氧容量（A错）、Pa02和肺换气功能（B错）、血红蛋白的质和量（C错）、静脉血氧饱和度和血流量（D错）都与题意不符。